关于肝硬化腹腔积液形成的因素，不正确的是
A. 门静脉压力增高
B. 原发性醛固酮增多
C. 低蛋白血症
D. 继发性醛固酮增多
E. 抗利尿激素分泌过多

正确答案：B。原发性醛固酮增多

解析：腹水是肝硬化失代偿期最常见和最突出的表现。腹水形成的机制：门静脉压力增高；低蛋白血症；继发性醛固酮和抗利尿激素增多。掌握“肝硬化”知识点。